20世纪，Forssman用豚鼠的肝、脾、肾上腺制备的生理盐水悬液注射家兔，得到抗体，除与相应的抗原反应外，还可使绵羊RBC发生凝集，出现这一现象是因为
A. 可能绵羊RBC发生了自身凝集
B. 豚鼠与绵羊间有完全相同的血型抗原
C. 豚鼠脏器与绵羊RBC间有共同抗原决定簇
D. 豚鼠脏器在制备过程中抗原结构发生了改变
E. 体外实验中，绵羊RBC的抗原性发生了改变

正确答案：C。豚鼠脏器与绵羊RBC间有共同抗原决定簇